初产妇，临产5小时，全腹痛1小时，阴道少量出血。检查血压80/50mmHg，脉搏120次/分。腹部检查：子宫板状硬，胎位不清，胎心听不到。最可能的诊断是
A. 子宫破裂
B. 先兆子宫破裂
C. 胎盘早剥
D. 忽略性肩先露
E. 脐带脱垂

正确答案：C。胎盘早剥

解析：初产妇，阴道少量出血，血压80/50mmHg（低于90/60mmHg），子宫板状硬、胎位不清、胎心听不到（胎盘早剥子宫子宫呈板状硬，胎位、胎心不清，阴道出血与贫血程度不成正比），该孕妇可考虑诊断为胎盘早剥（C对）。子宫破裂（A错）的产妇表现为突然的下腹撕裂样剧痛，之后可为持续性腹痛伴低血容量休克的征象。先兆子宫破裂（B错）常见于产程长、有梗阻性难产因素的产妇。忽略性肩先露（D错）会出现胎体折叠弯曲，胎颈被拉长，上肢脱处于阴道口外，胎头胎臀被阻于骨盆入口上方的的表现。脐带脱垂（E错）的产妇，脐带降至阴道内甚至露于外阴部且会出现胎儿窘迫的征象。